患者，女，46岁，已婚。近两周带下量多，色赤白相兼，质稠，有气味，阴部瘙痒，腰膝酸软，头晕耳鸣，舌红，苔黄腻，脉细数。其治法是
A. 清热疏肝，利湿止带
B. 滋肾养阴，清热利湿
C. 清热解毒止带
D. 健脾祛湿止带
E. 清热凉血止带

正确答案：B。滋肾养阴，清热利湿

解析：该患者以近两周带下量多，色赤白相兼为主症，故诊断为带下量多。肾阴不足，相火偏旺，损伤血络，或复感湿邪，损伤任带致任脉不固，带脉失约，故带下量多，色赤白相兼，质稠，有气味；腰为肾之府，肾虚则腰膝酸软，头晕耳鸣；阴虚生内热，故阴部瘙痒；舌红，苔黄腻，脉细数均为阴虚夹湿之象，故辨为阴虚夹湿证，治宜滋肾益阴，清热利湿（B对）。